关于丁型肝炎病毒的叙述中，正确的说法是
A. 是一种缺陷病毒
B. 其基因组是已知动物病毒中最小的
C. HDV和HBV传播途径相同
D. HDV和HBV包膜上均具有HBsAg
E. 以上均正确

正确答案：E。以上均正确

解析：丁型肝炎病毒（HDV）是已知动物病毒中最小的基因组。病毒复制必须有HBV或其他嗜肝DNA病毒辅助获得包膜，才能复制增殖，故称作缺陷性病毒。HDV和HBV包膜上均具有HBsAg，传播途径也相同，故接种乙肝疫苗可预防乙型肝炎兼预防丁型肝炎。掌握“丙型、丁型、戊型肝炎病毒”知识点。